男婴，9个月。发热3天，烦躁、流涎1天。查体：一般状态可，前囟平坦，咽部充血，咽峡及软腭部可见直径2～3mm的疱疹及溃疡，颈部无抵抗，心、肺听诊正常。其病原体最可能为
A. 溶血性链球菌
B. 腺病毒
C. 柯萨奇病毒
D. 副流感病毒
E. 流感嗜血杆菌

正确答案：C。柯萨奇病毒

解析：患儿，发热3天，并且咽部有充血、咽峡及软腭部有疱疹及溃疡，由此应诊断为疱疹性咽峡炎，一般导致疱疹性咽峡炎的病原体是柯萨奇病毒（C对）。金黄色葡萄球菌一般引发的是细菌性肺炎（A错）。导致咽结合膜热的病原体是腺病毒（B错）。副流感病毒（D错）和流感病毒（E错）是引起流行性感冒的病原体。